下列属于表情肌的是
A. 咬肌
B. 颞肌
C. 枕额肌
D. 翼外肌
E. 翼内肌

正确答案：C。枕额肌

解析：枕额肌（C对）属于面肌，即表情肌。咬肌（A错）、颞肌（B错）、翼外肌（D错）和翼内肌（E错）均属于咀嚼肌。